骨质疏松症引起的关节疼痛，宜选用
A. 雌激素或雌激素受体调节剂
B. 阿仑膦酸钠
C. 降钙素
D. 雄激素
E. 孕激素

正确答案：C。降钙素

解析：本题考查骨质疏松症的药物治疗。骨质疏松症引起的关节疼痛，宜选用降钙素（C对）。钙制剂+维生素D+雌激素/选择性雌激素受体调节剂（A错）用于妇女绝经后骨质疏松。钙制剂+维生素D+双膦酸盐（B错）用于老年性骨质疏松症。